小儿多发性抽动症的基本病理改变是
A. 瘀血阻窍
B. 肝风痰火胶结成疾
C. 痰瘀互阻
D. 肝风内动
E. 痰蒙清窍

正确答案：B。肝风痰火胶结成疾

解析：本病病位主要在肝，常涉及心、脾、肾三脏。肝风夹痰，风痰鼓动为其基本病机。肝亢风动，若情志失调，气机不畅，可化火生风而致肝亢风动。因风盛生痰，风痰鼓动，上犯清窍，流窜经络，则见眨眼、摇头、耸肩、秽语、肢体抽动。痰火扰心，小儿饮食不节，过食辛辣香燥、肥甘厚味，导致痰热内蕴，上扰心神，则抽动呼叫、秽语不由自主。脾虚肝旺，因素体脾虚，或饮食伤脾，或久病体虚，脾失健运，痰浊内生；因土虚木亢，肝风夹痰上扰走窜，则喉发异声、噘嘴、口唇蠕动。阴虚风动，因素体肾阴不足，或久病及肾，肾阴亏虚，水不涵木，可致筋脉失养而出现虚风内动。相火妄动，夹痰上扰，闭阻咽喉，金鸣异常，则喉发异声（B对）。